Ⅰ期临床试验对象是
A. 患者
B. 健康受试者
C. 特殊人群
D. 目标适应证患者
E. 普通或特殊人群患者

正确答案：B。健康受试者

解析：本题考查新药临床评价的分期。Ⅰ期临床试验对象是健康志愿者（B对）。Ⅱ期临床试验对象是目标适应证患者。Ⅲ期临床试验对象是目标适应证患者（D错）。IV期临床试验对象是普通或者特殊人群（E错）。